男性，18岁，自幼有哮喘，每年春季发作，用沙丁胺醇可缓解。今在公园春游时突感胸闷气急。此时不宜做哪项检查
A. 峰速仪测定
B. 血清IgE测定
C. 皮肤过敏原试验
D. 血嗜酸性粒细胞测定
E. 胸部X线

正确答案：C。皮肤过敏原试验